病因对疾病的作用在时间上必须在疾病发病
A. 之后
B. 同时
C. 之前
D. 以上都可能
E. 以上均不对

正确答案：C。之前

解析：本题考查病因。病因对疾病的作用在时间上必须在疾病发病之前（C对ABDE错）。病因发生在疾病之前才能称得上因果关系，因必须在果的前面。